禁用于妊娠妇女和小儿的药物是
A. 头孢菌素类
B. 氟喹诺酮类
C. 大环内酯类
D. 维生素类
E. 青霉素类

正确答案：B。氟喹诺酮类

解析：本题考查氟喹诺酮类药物的禁忌症。禁用于妊娠妇女和小儿的药物是氟喹诺酮类（B对）。头孢菌素类（A错）：对头孢菌素类药物过敏者、有青霉素过敏性休克或即刻反应史者禁用。大环内酯类（C错）禁用于对本类药物过敏者及部分心脏病患者。维生素类（D错）过敏者禁用。青霉素类（E错）禁用于有青霉素类药物过敏史或青霉素皮肤试验阳性患者。